心室肌细胞动作电位1期复极主要是由于
A. K⁺外流
B. Cl⁻内流
C. Na⁺内流
D. Ca²⁺内流
E. K⁺内流

正确答案：A。K⁺外流